当人群营养素需要量的分布为近似正态分布时，该营养素EAR与RNI的关系是
A. EAR＝RNI－2SD
B. RNI＝EAR－2SD
C. EAR＝RNI＋2SD
D. RNI＝EAR＋2SD
E. RNI＝EAR＋SD

正确答案：D。RNI＝EAR＋2SD

解析：本题考查当人群营养素需要量的分布为近似正态分布时，该营养素EAR与RNI的关系。当人群营养素需要量的分布为近似正态分布时，可计算出该营养素需要量的标准差（SD），EAR值加2倍SD可计算出RNI，即RNI＝EAR＋2SD（D对ABCE错）。